医患沟通的基本理念
A. 尊重与理解
B. 共同参与
C. 信托关系
D. 同情换位
E. 主动至上

正确答案：A。尊重与理解

解析：医患沟通的基本理念是尊重与理解（A对）。共同参与（B错）、主动至上（E错）是保证沟通渠道畅通、进行有效沟通的操作原则。信托关系（C错）是医患关系的实质。同情换位（D错）是“医乃仁术”最朴实的表达和表现。